通过排Na⁺而减少细胞内Ca²⁺，降低外周血管阻力的药物是
A. 卡托普利
B. 阿替洛尔
C. 哌唑嗪
D. 氯沙坦
E. 氢氯噻嗪

正确答案：E。氢氯噻嗪

解析：本题考查氢氯噻嗪。通过排Na⁺而减少细胞内Ca²⁺，降低外周血管阻力的药物是氢氯噻嗪（E对）。噻嗪类利尿药初期降压作用可能是通过排钠利尿，减少细胞外液和血容量，导致心排血量降低。长期用药的作用机制在于排Na⁺使细胞内Na⁺减少，结果导致：①血管壁细胞内Na⁺含量降低，经Na⁺-Ca²⁺交换机制，使细胞内Ca²⁺量减少，因而使血管平滑肌舒张；②细胞内钙的减少使血管平滑肌对收缩血管物质，如去甲肾上腺素等的反应性降低；③诱导动脉壁产生扩血管物质，如激肽、前列腺素等。卡托普利（A错）为血管紧张素转换酶抑制剂（ACEI），通过抑制血管紧张素Ⅰ转换成血管紧张素Ⅱ，同时抑制缓激肽降解，从而扩张血管，降低血压。阿替洛尔（B错）为β₁受体阻滞剂，通过阻断β₁受体，使心输出量减少，肾素分泌减少，从而降低外周阻力，降低血压。哌唑嗪（C错）能选择性阻滞血管平滑肌突触后膜α₁受体，同时舒张小动脉和小静脉，从而降低外周阻力，降低血压。氯沙坦（D错）属于血管紧张素Ⅱ受体阻断剂（ARB），通过拮抗血管紧张素Ⅱ与AT₁结合，松弛血管平滑肌，从而降低外周血管阻力，降低血压。